能利水通淋的药是
A. 薏苡仁
B. 川贝母
C. 车前子
D. 泽泻
E. 浙贝母

正确答案：C。车前子

解析：本题考查的是车前子的功效。能利水通淋的药是车前子（C对）。车前子：【功效】利水通淋，渗湿止泻，明目，清肺化痰。薏苡仁（A错）：【功效】利水渗湿，健脾止泻，除痹，清热排脓。川贝母（B错）：【功效】清热化痰，润肺止咳，散结消痈。泽泻（D错）：【功效】利水渗湿，泄热。浙贝母（E错）：【功效】清热化痰，散结消肿。